以上哪种类型的义齿适用于多数牙缺失，余留牙松动的情况
A. 金属铸造支架式义齿
B. 黏膜支持式义齿
C. 牙与黏膜混合支持式义齿
D. 胶连式义齿
E. 牙支持式义齿

正确答案：B。黏膜支持式义齿

解析：黏膜支持式义齿适用于多数牙缺失，余留牙松动，或因咬合过紧无法磨出（牙合）支托位置者。掌握“局部义齿类型，肯氏分类及模型观测”知识点。